缩宫素对子宫作用的特点有
A. 大剂量可使子宫平滑肌发生强直性收缩
B. 小剂量可使子宫收缩的作用与正常分娩相似
C. 对子宫血管有收缩作用
D. 作用与体内雌激素和孕激素水平有关
E. 作用强度与子宫生理状态和用药剂量有关

正确答案：A、B、D、E。大剂量可使子宫平滑肌发生强直性收缩；小剂量可使子宫收缩的作用与正常分娩相似；作用与体内雌激素和孕激素水平有关；作用强度与子宫生理状态和用药剂量有关